控制中枢性尿崩症的药物首选是
A. 氯磺丙脲
B. 垂体后叶素
C. 鞣酸加压素
D. 去氨加压素
E. 氢氯噻嗪

正确答案：D。去氨加压素

解析：中枢性尿崩症（P677）患者，AVP（精氨酸加压素）的合成、转运、储存及释放受到影响，导致其血中AVP浓度下降。由于其尿量增多的原因为精氨酸加压素缺乏，因此为减少尿量应补充精氨酸加压素或其类似物。去氨加压素（D对）是人工合成的加压素类似物，抗利尿作用强，且不良反应较少，为目前治疗尿崩症的首选药物。氯磺丙脲（A错）可刺激AVP释放并增强AVP对肾小管的作用，但抗利尿作用不及去氨加压素，临床上不作为首选治疗。垂体后叶素（B错）为激素替代治疗药物，需注射治疗，口服无效，且每次注射维持作用时间较短，每日需多次注射，不便长期应用，主要用于颅脑外伤或术后神志不清的尿崩症患者。鞣酸加压素（C错）注射后维持时间较长，可减少频繁注射的麻烦，但是长期应用两年左右会因产生抗体而减效，注射过量会引起水中毒。氢氯噻嗪（E错）为肾性尿崩症的主要治疗药物，也用于中枢性尿崩症，但效果不如去氨加压素好。